针灸治疗瘾疹，应主选的经穴是
A. 足阳明、足厥阴经
B. 足厥阴、足太阳经
C. 手阳明、足阳明经
D. 手阳明、足太阴经
E. 局部穴、相应夹脊穴

正确答案：D。手阳明、足太阴经

解析：治疗瘾疹的治法为祛风止痒，养血和营，以手阳明、足太阴、足太阳经穴为主（D对）。